女，23岁，发热、腹痛1周，半月前流产并清宫，T38.8℃，下腹压痛反跳痛，宫口脓性分泌物，子宫大，压痛（+），双附件压痛，WBC及N升高，诊断为
A. 异位妊娠
B. 盆腔炎性疾病
C. 溃疡性结肠炎
D. 不全流产
E. 急性阑尾炎

正确答案：B。盆腔炎性疾病

解析：23岁女性患者（发病人群），发热腹痛1周（提示病情严重），半月前流产并清宫（提示性生活活跃），T:38.8℃，下腹压痛反跳痛（提示有脓肿形成），宫口脓性分泌物（提示子宫颈管黏膜或宫腔有急性炎症），子宫大，压痛（+），双附件压痛（盆腔炎性疾病常见体征），WBC及N升高（提示感染），结合患者的症状、体征、实验室检查，考虑诊断为盆腔炎性疾病（B对）。异位妊娠（A错）典型症状为停经、腹痛与阴道流血，一般妇科检查：阴道内常有来自宫腔的少许血液表现。溃疡性结肠炎（C错）一般以反复发作的腹泻、黏液脓血便及腹痛为主要症状。不全流产（D错）一般有腹痛、反复的阴道流血等症状。急性阑尾炎（E错）一般有转移性右下腹痛、麦氏点压痛阳性等表现。